表示暴露人群中的发病归因于暴露的成分占全部发病的百分比
A. RR
B. AR
C. AR%
D. OR
E. PARP

正确答案：C。AR%